治疗严重房室传导阻滞宜选用
A. 肾上腺素
B. 去甲肾上腺素
C. 异丙肾上腺素
D. 阿托品
E. 氨茶碱

正确答案：C。异丙肾上腺素

解析：异丙肾上腺素舌下含药或静脉滴注给药，治疗Ⅱ、Ⅲ度房室传导阻滞。掌握“多巴胺和异丙肾上腺素”知识点。